新生儿，临床诊断为双侧完全性唇、腭裂。伴发的鼻畸形，应在何时进行手术
A. 出生后6～12个月
B. 出生后12～18个月
C. 出生后5～6岁
D. 患儿13岁以后
E. 患儿成人以后

正确答案：D。患儿13岁以后

解析：本题考查鼻畸形矫治术的时间。多数学者认为婴幼儿期施行鼻畸形矫治术，会过多剥离鼻翼软骨而损伤其软骨膜，而影响到鼻翼软骨的正常发育，导致成年后出现难以矫正的鼻翼不对称畸形，而应推迟到13岁以后（D对）。因此出生后3～6个月（A错）、出生后6～12个月（B错）、出生后12～18个月（C错）都不宜进行手术。若待患者患儿成人以后（E错）成长至24岁，此时发育已经停止，鼻翼软骨已成形，手术效果不会很理想。